最不易发生淋巴结转移的是
A. 舌癌
B. 唇癌
C. 颊癌
D. 牙龈癌
E. 上颌赛癌

正确答案：B。唇癌

解析：本题考查口腔癌的转移。最不易发生淋巴结转移的是唇癌（B对）。唇癌生长较慢，一般无自觉症状，以后肿瘤向周围皮肤及黏膜扩散，同时向深部肌组织浸润；晚期可波及口腔前庭及颌骨。下唇癌常向颏下及下颌下淋巴结转移；而上唇癌则向耳前、下颌下及颈淋巴结转移。上唇癌的转移较下唇早，并较多见。舌癌（A错）颈淋巴转移率最高，且早期转移。颊癌（C错）常转移至面淋巴结、下颌下及颈深上淋巴结，有时也可转移至腮腺淋巴结，远处转移较少见。牙龈癌（D错）生长较慢，下颌牙龈癌比上颌牙龈癌淋巴结转移早，同时也较多见。上颌窦癌（E错）上颌窦癌常转移至下颌下及颈上部淋巴结，有时可转移至耳前及咽后淋巴结，远处转移少见。